龈上菌斑定义正确的是
A. 未矿化的细菌性沉积物，牢固黏附于牙面和修复体表面，由细菌构成
B. 未矿化的细菌性沉积物，牢固黏附于牙面和修复体表面，由黏性基质和嵌入其中的细菌构成
C. 部分矿化的细菌性沉积物，牢固黏附于牙面和修复体表面，由黏性基质和嵌入其中的细菌构成
D. 矿化的细菌性沉积物，牢固黏附于牙面和修复体表面，由黏性基质和嵌入其中的细菌构成
E. 以上均不对

正确答案：B。未矿化的细菌性沉积物，牢固黏附于牙面和修复体表面，由黏性基质和嵌入其中的细菌构成

解析：本题考查龈上菌斑的定义。位于龈缘以上的牙菌斑称为龈上菌斑，主要分布在近牙龈的1/3牙冠处和牙其他不易清洁的窝沟、裂隙、邻接面等部位，是未矿化的细菌性沉积物，牢固黏附于牙面和修复体表面，由黏性基质和嵌入其中的细菌构成（B对A错）。菌斑尚未矿化，矿化后形成牙石（CD错）。